经测定，某居室内重离子与轻离子的比值＞50，引起这种情况的污染物，最有可能的是
A. CO
B. SO₂
C. CO₂
D. 悬浮颗粒物
E. NO₂

正确答案：D。悬浮颗粒物

解析：本题考查重离子与轻离子比值＞50的污染物。悬浮颗粒物是指悬浮在空气中的固体颗粒，它们可以是矿物质、有机物或者是混合物，其中包括灰尘、烟尘、火山灰、沙尘、病菌、病毒等。因此，悬浮颗粒物（D对ABCE错）是居室内重离子和轻离子比值＞50的最有可能的污染物。